男，31岁。乏力、皮肤颜色变黑2年、1周前受凉后出现恶心、呕吐。血Na⁺120mmol/L，血K⁺5.8mmol/L。可能的病变部位是
A. 肾上腺
B. 肾脏
C. 垂体前叶
D. 垂体后叶
E. 下丘脑

正确答案：A。肾上腺

解析：31岁中青年男性患者，乏力、皮肤颜色变黑2年、1周前受凉后（有前驱史）出现恶心、呕吐（提示高钾血症）。血Na⁺120mmol/L（正常值130～150mmol/L），血K⁺5.8mmol/L（正常值3.5～5.5）mmol/L。患者实验室检查提示低血钠高血钾，为肾上腺皮质激素分泌不足导致。考虑诊断原发性慢性肾上腺皮质功能减退症，是由于双侧肾上腺的绝大部分被毁所致，可能的病变部位为肾上腺（A对，BCDE错）。